高血压合并支气管哮喘的患者，不宜使用的药物是
A. 硝苯地平
B. 贝那普利
C. 美托洛尔
D. 氢氯噻嗪
E. 哌唑嗪

正确答案：C。美托洛尔

解析：临床上高血压治疗主要应用利尿剂、β受体拮抗剂、CCB（钙通道阻滞剂）、ARB（血管紧张素Ⅱ受体拮抗剂）、ACEI（血管紧张素转换酶抑制剂），哮喘治疗时需要使用β受体激动剂。美托洛尔（C错，为本题正确答案）为β受体拮抗剂，这类药物在降低血压的同时，会引起支气管痉挛，导致支气管收缩，加重支气管哮喘病情。硝苯地平属于二氢砒啶类CCB，无绝对禁忌症（A对）。贝那普利属于ACEI，禁用于妊娠、高钾血症、双侧肾动脉狭窄患者（B对）。氢氯噻嗪属于利尿剂，痛风者禁用（D对）。哌唑嗪为α1受体拮抗剂，首剂会产生体位性低血压，其他不良反应有眩晕、疲倦、口干、头痛及恶心等（E对）。